患者身热不恶寒，反恶热，烦渴喜冷饮，神昏谵语，便秘溲赤，手足逆冷，舌红苔黄而干，脉沉数有力。其证候是
A. 表寒里热
B. 表热里寒
C. 真热假寒
D. 真寒假热
E. 上热下寒

正确答案：C。真热假寒

解析：表寒里热证为外感风寒，内有里热之象，内热多有心烦口渴、咽喉肿痛、痰黄黏稠、大便秘结等症状，外寒为发热、恶寒、无汗等证（A错）。表热里寒证为表里同病，表有热而里有寒得证候，常见素有里寒而外感风热所致（B错）。真热假寒指内有真热而外见某些假寒的“热极似寒”证候，题中患者身热不恶寒，反恶热，烦渴喜冷饮，神昏谵语，便秘溲赤为里热证，而手足逆冷，脉沉的假寒证为邪热内盛，气血运行不畅，阳气郁闭于内而不能外达所致，为真热假寒证（C对）。真寒假热证为内有真寒而外见某些假热的“寒极似热”的证候，多为四肢厥冷、小便色清、大便不燥或下利清谷、舌淡苔白、脉沉的里虚寒证伴自觉发热但触之无灼热感、面色发红却为颧红如状、燥扰不宁却感疲乏无力的假热之象（D错）。上热下寒为在同一时间内，表现为上部有热，下部为寒得证候，如胸中有热，心烦口渴，咽干而痛，而又见腹痛喜暖，大便溏，小便清长等下寒证（E错）。